再障与低增生性白血病的主要鉴别点是
A. 贫血程度
B. 骨髓增生情况
C. 外周血白细胞增多与否
D. 骨髓象原始或幼稚细胞是否增多
E. 血小板是否减少

正确答案：D。骨髓象原始或幼稚细胞是否增多

解析：低增性白血病骨髓象有原始或幼稚细胞增多，而再障表现为骨髓造血功能低下（D对）。低增生性白血病和再障均能导致不同程度贫血，故贫血程度难以鉴别（A错）。二者有骨髓增生的减低（B错）。外周血涂片中如果出现明确的原始粒细胞要考虑低增生性白血病，二者的白细胞都可能出现减少（C错）。由于二者都可能出现全血细胞减少，故二者血小板可能都出现减少，所以无法鉴别（E错）。